痄腮病好发的年龄阶段是
A. 儿童期
B. 幼童期
C. 幼儿期
D. 婴儿期
E. 新生儿期

正确答案：A。儿童期

解析：痄腮即流行性腮腺炎，本病一年四季都有发生，冬春两季较易流行。任何年龄均可发病，尤以5～15岁为多，即包括幼童期、学龄期和青春期，选项儿童期能涵盖这三个时期（A对）。